白豆蔻的功效是
A. 化湿，解暑
B. 化湿，行气
C. 化湿，安胎
D. 燥湿，利尿
E. 燥湿，降逆

正确答案：B。化湿，行气

解析：本题考查的是白豆蔻的功效。白豆蔻的功效是化湿，行气（B对）。白豆蔻：【功效】化湿行气，温中止呕。广藿香：【功效】化湿，止呕，发表解暑（A错）。砂仁：【功效】化湿行气，温中止泻，安胎（C错）。苦参：【功效】清热燥湿，杀虫止痒，利尿（D错）。半夏：【功效】燥湿化痰，降逆（E错）止呕，消痞散结。